常见于躁狂症
A. 情感幼稚、哭笑无常、行为紊乱
B. 思维贫乏、生活懒散、情感淡漠
C. 青壮年发病、幻觉妄想突出
D. 情感高涨、思维奔逸、言语行为增多
E. 情感低语、思维迟缓、言语行为减少

正确答案：D。情感高涨、思维奔逸、言语行为增多